牙震荡不正确的处理是
A. 患牙休息
B. 必要时调（牙合）
C. 立即行牙髓摘除术
D. 患牙松动行固定术
E. 定期复查，必要时做根管治疗术

正确答案：C。立即行牙髓摘除术

解析：牙震荡的治疗：1～2周内应使患牙休息。必要时降低咬合以减轻患牙的（牙合）力负担。松动的患牙应进行固定。定期复查：应在第1、3、6、12个月进行。观察1年后，若牙冠不变色，牙髓活力测试正常，可不进行处理；若有牙髓坏死迹象时，应进一步作根管治疗术。必须记住，在年轻恒牙，其活力可在受伤1年后才丧失。掌握“牙震荡”知识点。